4个月男婴，因夜惊多汗，烦躁2个月就诊，患儿生后母乳喂养，未加辅食，医生诊断为“维生素D缺乏性佝偻病初期”对家长说明此患儿可能的致病原因。哪项是不正确的
A. 食物中维生素D含量不足
B. 食物中钙磷比例不调
C. 日光照射不足
D. 婴儿生长发育快
E. 肾小管对钙、磷重吸收不足

正确答案：E。肾小管对钙、磷重吸收不足

解析：维生素D缺乏性佝偻病的病因包括食物中钙、磷含量过低或比例不当食物中钙磷比例直接影响钙、磷的吸收，母乳钙磷比例适宜（2:1），钙的吸收率较高；而牛乳钙磷含量虽高于人乳，但钙磷比例不当（1.2:1），钙的吸收率较低，故人工喂养者更易发生佝偻病。掌握“维生素D缺乏性佝偻病”知识点。